四物汤主治的证候是
A. 气衰血少
B. 劳倦内伤
C. 冲任虚损
D. 郁怒伤肝
E. 阴精亏虚

正确答案：C。冲任虚损

解析：四物汤功用为补血和血；本方熟地、白芍阴柔补血之品与辛甘之当归、川芎相配，动静相宜，重在滋补营血，且补中寓行，治疗营血不足，冲任失司之月经不调，或经闭不行之营血虚滞证（C对）。